在生活饮用水标准中，被IARC列为对人可能的致癌物（2B类）不包括
A. 卤代羟基呋喃酮
B. 溴酸盐（钾）
C. 三氯甲烷
D. 四氯化碳
E. 三氯乙酸

正确答案：E。三氯乙酸

解析：本题考查被IARC列为对人可能的致癌物（ⅡB类）的物质。在生活饮用水标准中，被IARC列为对人可能的致癌物（ⅡB类）包括卤代羟基呋喃酮（A对）、溴酸盐（钾）（B对）、三氯甲烷（C对）、四氯化碳（D对）、一溴二氯甲烷、二氯乙酸等。而三氯乙酸（E错，为本题正确答案）被列为无法分类的致癌物（ⅢB类）。